无牙颌口腔专项检查的内容
A. 黏膜
B. 牙槽嵴
C. 系带和肌肉的附着
D. 上下颌弓的形状和位置关系
E. 以上都对

正确答案：E。以上都对

解析：口内检查：①牙槽嵴；②黏膜；③系带和肌肉的附着；④腭穹隆的形状；⑤上下颌弓的形状和位置关系。掌握“全口义齿口腔检查及修复前准备”知识点。